女性，60岁。反复黑便，呕吐咖啡色液体1月余，消瘦，未触及肿块，血红蛋白50g/L，白细胞6.5×10⁹/L，最大可能是
A. 急性胃炎
B. 慢性胃炎
C. 胃癌
D. 胃溃疡
E. 十二指肠溃疡

正确答案：C。胃癌

解析：老年女性患者，反复黑便、呕吐咖啡色液体（呕血）1月余，消瘦，血红蛋白50g/L（成年女性正常为110～150g/L），提示重度贫血（溃疡型胃癌出血时可引起呕血或黑粪，继之出现贫血）。综合患者病史与实验室检查，考虑诊断为胃癌（C对）。急性胃炎（P353）（A错）临床表现主要有上腹痛、胀满、恶心、呕吐和食欲不振，重症患者亦可出现呕血、黑粪，但不会出现贫血或消瘦等恶病质表现。慢性胃炎（P355）（B错）患者可出现中上腹不适、饱胀、钝痛、烧灼痛等，亦可出现体重减轻、贫血，但不会出现呕血、黑便。胃溃疡（P359）（D错）多见于中老年，十二指肠溃疡（E错）多见于青壮年，二者均呈周期性、节律性上腹痛，腹痛可被抑酸或抗酸药缓解。